流行性脑脊髓膜炎的传播途径是
A. 直接通过空气飞沫传播
B. 直接接触传播
C. 经接触疫水传播
D. 经吸血节肢动物传播
E. 经污染媒介物间接传播

正确答案：A。直接通过空气飞沫传播